某男，48岁。反复胃脘疼痛多年。近日加重，症见胃脘隐隐灼痛、似饥而不欲食、口燥咽干、五心烦热、消瘦乏力、口渴思饮、大便干结，舌红少津、脉细数。医师诊为胃阴亏耗、中焦失和，治以养阴益胃、和中止痛。处方：北沙参10g、麦冬10g、生地黄10g、枸杞子10g、当归10g、炒川楝子5g、梅花3g、佛手5g、生白芍9g、灸甘草10g，7剂，每日1剂，水煎服。方中能缓急止痛的药组是
A. 当归、梅花
B. 枸杞子、炒川楝子
C. 生地黄、生白芍
D. 北沙参、佛手
E. 生白芍、炙甘草

正确答案：E。生白芍、炙甘草

解析：本题考查甘草配伍。方中能缓急止痛的药组是生白芍、炙甘草（E对）。甘草【配伍】甘草配白芍：甘草味甘，功能补气缓急；白芍酸收，功能养血柔肝。两药相合，缓急止痛力强，治脘腹或四肢拘急疼痛。当归【功效】补血活血，调经止痛，润肠通便。梅花（A错）【功效】疏肝解郁，和中，化痰。枸杞子【功效】滋补肝肾，明目，润肺。炒川楝子（B错）【功效】行气止痛，杀虫，疗癣。生地黄【功效】清热凉血，养阴生津，润肠。生白芍（C错）【功效】养血调经，敛阴止汗，柔肝止痛，平抑肝阳。北沙参【功效】养阴清肺，益胃生津。佛手（D错）【功效】疏肝理气，和中，化痰。